胸膈疼痛，食不得下，或虽下而复吐出，甚至水饮难下，大便坚如羊粪，或吐出物如赤小豆，形体消瘦，肌肤枯燥，舌红少津，或舌质紫暗，脉细涩，其治法为
A. 开郁化痰，润燥降气
B. 滋养津液，泻热散结
C. 破结行瘀，滋阴养血
D. 温补脾肾，益气回阳
E. 养阴生津，和胃降逆

正确答案：C。破结行瘀，滋阴养血

解析：根据“胸膈疼痛，食不得下，或虽下而复吐出”，可知病为“噎膈”；根据“或吐出物如赤小豆，形体消瘦，肌肤枯燥，舌红少津，或舌质紫暗，脉细涩”，可辨为“瘀血内结证”，治疗应以破结行瘀，滋阴养血为法（C对）。“开郁化痰，润燥降气”是噎膈痰气交阻证的治法（A错）。“滋养津液，泻热散结”是噎膈津亏热结证的治法（B错）。“温补脾肾，益气回阳”是噎膈气虚阳微证的治法（D错）“养阴生津，和胃降逆”是呕吐胃阴不足证的治法（E错）。